进行空气或物体表面的化学消毒时，最适宜的消毒方法是
A. 浸泡法
B. 熏蒸法
C. 喷雾法
D. 擦拭法
E. 紫外线

正确答案：C。喷雾法

解析：本题考查空气或物体表面最适宜的化学消毒方法。喷雾法是用喷雾器将化学消毒剂均匀喷洒在空气中和物体表面进行消毒的方法。因此，进行空气或物体表面的化学消毒时，最适宜的消毒方法是喷雾法（C对ABDE错）。